急性病患者在治疗过程中所属的医患关系模式是
A. 主动-被动型
B. 指导-合作型
C. 共同参与型
D. 权威模式
E. 合作模式

正确答案：B。指导-合作型

解析：本题考查医患关系模式的类型。急性病患者在治疗过程中所属的医患关系模式是指导-合作型（B对）。医患关系模式的类型：1.主动-被动型（A错）：它是传统的医患关系模式，普遍存在于现代医学实践中。其特征是医生对患者单向作用，“为患者做什么”。医疗中，医生完全把握了医疗的主动权、决策权，即怎样医疗全由医生说了算，病人无任何自己的意志参与医疗，医生是绝对权威。这种模式的优点是能充分发挥医生纯技术的优势，缺点是彻底否定了患者的个人意志，可能会影响疗效并为医患纠纷埋下隐患。所以，这种模式一般适用于急症重伤、麻醉等意识丧失情况下的抢救医疗。这一模式用父母与婴儿的关系比较相似。2.指导-合作型：它应属于现代医学实践中医患关系的基础模型。这种模式中，医生仍占有主导地位，而患者能有条件有限度地表达自己的意志，但必须接受医生的解释并执行医生的治疗方案，患者“被要求与医生合作”。它的特征是：“告诉患者做什么”。该模式的进步意义是显而易见的，它因为有互动的成份，能较好地发挥医患双方的积极性，提高疗效、减少差错，有利于建立信任合作的医患关系。但它的不足是医患双方的权利的不平等性仍较大。这种医患关系类似父母与青少年（子女）的关系。它一般常见于急性病或垂危病但头脑清醒的患者的就医过程。3.共同参与型（C错）：它是前两种医患关系基础上发展而来的医生以平等的观念和言行方式，听取并尊重患者的想法，医患双方共同制定并积极实施医疗方案。它的特征是：“帮助患者自疗”。这种医患关系就如成年人之间的相互关系，有助于医患双方的理解沟通，融洽关系，提高疗效，改善关系。这种模式适用于慢性病患者，而且更适用于有一定医学知识的患者。